关于双侧颞下颌关节急性前脱位的叙述，哪项是错误的
A. 前牙开（牙合），不能闭口
B. 下颌前伸，颏部前突
C. 耳屏前肿胀，后牙接触
D. 必要时作X线检查除外髁状突骨折
E. 复位后应限制下颌运动，2～3周

正确答案：C。耳屏前肿胀，后牙接触

解析：急性前脱位可为单侧或双侧。双侧脱位的症状是：①下颌运动异常，患者呈开口状，说话、咀嚼和吞咽均有困难；检查时可见前牙开（牙合）、反（牙合）②下颌前伸，两颊变平。③触诊耳屏前方有凹陷，在颧弓下可触到脱位的髁突。④X线片可见髁突脱位于关节结节前上方。单侧急性前脱位者，颏部中线及下前牙中线偏向健侧，健侧后牙反（牙合）。掌握“颞下颌关节脱位”知识点。